“健康所系，性命相托”这一提法出自
A. 1991年《中国医学生誓词》
B. 2000年《中国医学生誓词》
C. 1996年《临床医师公约》
D. 2002年《临床医师公约》
E. 1999年《中华人民共和国执业医师法》

正确答案：A。1991年《中国医学生誓词》